一个供精者的精子最多只能提供给
A. 8名妇女受孕
B. 6名妇女受孕
C. 2名妇女受孕
D. 5名妇女受孕
E. 4名妇女受孕

正确答案：D。5名妇女受孕